玉屏风散的主治证是
A. 表虚自汗证
B. 气阴两虚证
C. 心脾两虚证
D. 脾虚气陷证
E. 脾虚挟湿证

正确答案：A。表虚自汗证

解析：玉屏风散的功用为益气固表止汗，主治表虚自汗。汗出恶风，面色㿠白，舌淡苔薄白，脉浮虚。亦治虚人腠理不固，易于感冒（A对）。新加黄龙汤的主治证是气阴两虚证（B错）。归脾汤的主治证是心脾两虚证（C错）。补中益气汤的主治证是脾虚气陷证（D错）。参苓白术散的主治证是脾虚挟湿证（E错）。